某男性患者，37岁。不慎被锅炉房锅炉炸伤，被烧伤部位有面部、颈部、双手、双前臂，则该病人烧伤总面积为
A. 0.2
B. 0.1
C. 0.12
D. 0.17
E. 0.27

正确答案：D。0.17

解析：本题考查烧伤面积的估算。某男性患者，37岁。不慎被锅炉房锅炉炸伤，被烧伤部位有面部（3％）、颈部（3％）、双手（5％）、双前臂（6％），则该病人烧伤总面积为17%（D对）。